口腔保健服务包括
A. 定期口腔检查
B. 适当应用氟化物
C. 尽早进行窝沟封闭
D. 减少糖与甜食摄取
E. 以上说法均正确

正确答案：E。以上说法均正确

解析：口腔保健服务包括：①适当应用氟化物；②尽早进行窝沟封闭；③减少糖与甜食摄取；④定期口腔检查。掌握“残疾人口腔保健”知识点。